女性，55岁。高血压、冠心病患者，近日加班工作后，心前区闷痛发作频繁，伴头痛，休息后不能缓解，测血压为20/13.3kPa（150/100mHg），心电图示R波为主导联ST﹣T缺血性改变，应采用何种药物治疗最为适宜
A. 洋地黄
B. 利多卡因
C. 硝苯地平
D. 硝酸甘油
E. 硝酸异山梨酯

正确答案：C。硝苯地平